外伤后髋关节屈曲、内收、内旋畸形，可能的诊断是
A. 髋关节中心脱位
B. 骨干骨折
C. 髋关节后脱位
D. 股骨颈骨折
E. 髋关节前脱位

正确答案：C。髋关节后脱位

解析：髋关节脱位可分为前脱位、后脱位和中心脱位。后脱位（C对）表现为髋关节屈曲、内收、内旋畸形；前脱位（E错）的特点是外展、外旋和屈曲畸形；中心脱位（A错）表现为髋部肿胀、疼痛、活动障碍及大腿上外方血肿。股骨颈骨折（D错）时患肢可出现短缩、外旋畸形。股骨干骨折（B错）时可出现畸形、骨擦音或骨擦感等骨折特有体征。